能祛寒止痛的药是
A. 香附
B. 青皮
C. 川楝子
D. 荔枝核
E. 化橘红

正确答案：D。荔枝核

解析：本题考查的是荔枝核的功效。能祛寒止痛的药是荔枝核（D对）。荔枝核：【功效】行气散结，祛寒止痛。香附（A错）：【功效】疏肝理气，调经止痛。青皮（B错）：【功效】疏肝破气，消积化滞。川楝子（C错）：【功效】行气止痛，杀虫，疗癣。化橘红（E错）：【功效】理气宽中，燥湿化痰，消食。